慢性化脓性唾液腺炎在患侧腺体受到压迫时导管口流出的液体为
A. 絮状唾液
B. 少量黏稠而有咸味液体
C. 胶冻状液体
D. 黏稠脓性分泌物
E. 含有“硫磺颗粒”的脓液

正确答案：B。少量黏稠而有咸味液体

解析：慢性化脓性唾液腺炎在患侧腺体受到压迫时导管口流出少量黏稠而有咸味的液体。掌握“坏死性唾液腺化生与舍格伦综合征”知识点。